某女，56岁。素有关节疼痛，刻下因咳嗽痰多就诊。诊断为：1）痹证，证属痛痹；2）咳嗽，证属痰热壅肺。处方：橘红丸（化橘红、浙贝母、陈皮、制半夏、茯苓、苦杏仁、紫苏子、桔梗、紫菀、款冬花、瓜蒌皮、石膏、地黄、麦冬、甘草）；小活络丸（制川乌、制草乌、制乳香、制没药、胆南星、地龙）。执业药师对该处方进行审核，发现其存在的配伍问题是
A. 相使药同用
B. 相杀药同用
C. 相反药同用
D. 相恶药同用
E. 相畏药同用

正确答案：C。相反药同用

解析：本题考查的是十八反。素有关节疼痛，刻下因咳嗽痰多就诊。诊断为：1）痹证，证属痛痹；2）咳嗽，证属痰热壅肺。处方：橘红丸化橘红、浙贝母、陈皮、制半夏、茯苓、苦杏仁、紫苏子、桔梗、紫菀、款冬花、瓜蒌皮、石膏、地黄、麦冬、甘草）；小活络丸制川乌、制草乌、制乳香、制没药、胆南星、地龙）。执业药师对该处方进行审核，发现其存在的配伍问题是相反药同用（C对）。十八反列述了三组相反药，分别是：甘草反甘遂、京大戟、海藻、芫花；乌头（川乌、附子、草乌）反半夏、瓜蒌（全瓜蒌、瓜蒌皮、瓜蒌仁、天花粉）、贝母（川贝、浙贝）、白蔹、白及；藜芦反人参、南沙参、丹参、玄参、苦参、细辛、芍药（赤芍、白芍）。相使（A错）：即性能功效有某种共性的两药同用，一药为主，一药为辅，辅药能增强主药的疗效。如以补气利水的黄芪为主，配以利水健脾的茯苓为辅，茯苓能增强黄芪的补气利水效果等。相杀（B错）：即一种药物能减轻或消除另一种药物的毒烈之性。如生姜能减轻或消除生半夏的毒性，故习云生姜杀半夏。相恶（D错）：即两药合用，一种药物能使另一种药物原有功效降低，甚至丧失。如人参恶莱菔子，因莱菔子能削弱人参的补气作用。十九畏（E错）列述了九组十九味相反药，具体是：硫黄畏朴硝（包括芒硝、玄明粉），水银畏砒霜，狼毒畏密陀僧，巴豆（包括巴豆霜）畏牵牛子（包括黑丑、白丑），丁香（包括母丁香）畏郁金，川乌（包括附子）、草乌畏犀角，芒硝（包括玄明粉）畏三棱，官桂畏石脂，人参畏五灵脂。